女，37岁，检查右上1腭侧一局限性深牙周袋6mm，颊侧龈缘下2mm处可见一窦道口，但颊侧牙周探诊2mm，牙髓活力正常，此牙周袋最可能属于哪类型牙周袋
A. 一壁袋
B. 龈袋
C. 复合牙周袋
D. 复杂牙周袋
E. 骨上袋

正确答案：D。复杂牙周袋

解析：本题考查牙周袋的类型。该患者腭侧存在深牙周袋，颊侧龈缘下2mm存在窦道口，且颊侧牙周探诊深度为2mm，符合复杂牙周袋（D对）的特征，复杂牙周袋是一种螺旋型袋，起源于一个牙面，但扭曲回旋于一个以上的牙面或根分叉区，通常可由窦道或瘘管引起。一壁袋（A错）常见于邻面骨间隔区，仅有邻牙一侧的骨壁残留。龈袋（B错）是指由于牙龈的肿胀或增生使龈缘位置向牙冠方向移动，使龈沟加深，形成的假性牙周袋。复合牙周袋（C错）是指累及2个以上的牙面的牙周袋。骨上袋（E错）是指袋底位于釉牙骨质界的根方、牙槽骨嵴的冠方，袋壁软组织位于牙根面与牙槽骨之间的真性牙周袋。